釉质的基本结构是釉柱，釉柱自釉牙本质界至牙表面的行程并不是完全呈直线，哪部分较直
A. 近表面1/2
B. 近表面1/3
C. 内1/2
D. 内1/3
E. 内2/3

正确答案：B。近表面1/3

解析：本题考查与釉柱排列方向相关的结构。釉质的基本结构是釉柱。釉柱是细长的柱状结构，起自釉牙本质界，贯穿釉质全层而达牙的表面。釉柱自釉牙本质界至牙表面的行程并不完全呈直线，近表面1/3（B对A错）较直，而内2/3（CDE错）弯曲。